女，24岁。咳嗽、低热1周，右胸痛1天。查体：T38℃，右肺呼吸音减弱，可闻及胸膜摩擦音。血WBC5.3×10⁹/L，N0.41。该患者最可能的诊断是
A. 肺结核
B. 自发性气胸
C. 肺血栓栓塞症
D. 肺炎
E. 胸膜炎

正确答案：E。胸膜炎

解析：患者为青年女性，低热一周，血WBC5.3×10⁹/L（正常值4～10×10⁹/L）、N（中性粒细胞）0.41（正常百分比范围为0.50～0.70），胸痛，呼吸音减低，闻及胸膜摩擦音，根据其临床表现和辅助检查，考虑诊断为结核性胸膜炎（E对）。肺结核（65）（A错）多表现为结核中毒全身症状，低热盗汗，食欲减退，咳嗽，X线可见肺部典型炎性浸润。自发性气胸（P120）（B错）多在持重物等诱因下发生，突发胸痛，呼吸音减弱，触觉语颤减弱，不会出现胸膜摩擦音。肺血栓栓塞（P100）（C错）表现为突发性胸痛、呼吸困难，未累及胸膜，不会出现胸膜摩擦感。肺炎（P42）（D错）多为细菌感染，高热，白细胞和中性粒细胞会明显增高，患者两者并不高。